肢体浮肿，小便不利，大便溏泄，脘腹胀闷，面色不华，神疲乏力，四肢倦息；舌质淡，苔白滑，脉沉缓。辨析其证候是
A. 肾阳衰微证
B. 脾阳虚衰证
C. 水湿浸渍证
D. 湿热壅盛证
E. 脾肾阳虚证

正确答案：B。脾阳虚衰证

解析：本题考查水肿之脾阳虚衰证的症状。辨析其证候是水肿之脾阳虚衰（B对）证。水肿之脾阳虚衰证【症状】身肿日久，腰以下为甚，按之凹陷不易恢复，脘腹胀闷，纳减便溏，面色不华，神疲乏力，四肢倦怠，小便短少。舌质淡，苔白腻或白滑，脉沉缓或沉弱。水肿之肾阳衰微证（A错）【症状】水肿反复消长不已，面浮身肿，腰以下甚，按之凹陷不起，尿量减少或反多，腰酸冷痛，四肢厥冷，怯寒神疲，面色㿠白，甚者心悸胸闷，喘促难卧，腹大胀满。舌质淡胖，苔白，脉沉细或沉迟无力。水肿之水湿浸渍证（C错）【症状】全身水肿，下肢明显，按之没指，小便短少，身体困重，胸闷，纳呆，泛恶。苔白腻，脉沉缓。起病缓慢，病程较长。水肿之湿热壅盛证（D错）【症状】遍体浮肿，皮肤绷急光亮，胸脘痞闷，烦热口渴，小便短赤，或大便干结。舌红，苔黄腻，脉沉数或濡数。脾肾阳虚证（E错）的临床表现及辨证要点：脾肾阳虚证的临床表现，常见畏寒肢冷，气短懒言，身体倦怠，大便溏泻或五更泄泻，或见浮肿，甚则腹满膨胀，舌质淡，苔白润，脉细弱。气短懒言、倦怠乏力、便溏等为脾阳虚的见症。畏寒肢冷、五更泄泻则主要为肾阳虚的见症。又肾主水，脾能运化水液，故脾肾阳虚可出现浮肿，甚则水停于腹腔内，可致腹满膨胀。舌质淡、苔白润、脉细弱，均为阳虚之征。一般以腰膝、下腹冷痛，久泻不止，浮肿等与寒证并见为辨证要点。